小儿呼吸道感染最常见的病原体是
A. 细菌
B. 病毒
C. 支原体
D. 衣原体
E. 真菌

正确答案：B。病毒

解析：本题考查小儿呼吸道感染最常见的病原体。小儿呼吸道感染最常见的病原体是病毒（B对），约占90％以上。细菌（A错）、支原体（C错）也可引起上呼吸道感染。衣原体（D错）可引起肺炎、沙眼及泌尿生殖系感染。真菌（E错）主要引起浅表皮肤感染、深部真菌感染。